尘肺按病因分类，哪一种是错误的
A. 硅酸盐肺
B. 碳尘肺
C. 棉尘肺
D. 金属尘肺
E. 矽肺

正确答案：C。棉尘肺